水湿内停时，面部颜色可见
A. 青色 赤色
B. 黑色 青色
C. 黄色 黑色
D. 赤色 白色
E. 赤色 黑色

正确答案：C。黄色 黑色

解析：黄色主脾虚、湿证。病人面色发黄，多由脾虚机体失养，或湿邪内蕴、脾失运化所致。黑色主肾虚、寒证、水饮、血瘀、疼痛。病人面色发黑，多因肾阳虚衰，水寒内盛，血失温养，或因剧痛，脉络拘急，血行不畅所致，其中面色黧黑，肌肤甲错者，多由血瘀日久所致（C对）。青色（AB错）主寒证、气滞、血瘀、疼痛、惊风。赤色（DE错）主热证，亦可见于戴阳证。